下列哪种检查方法能准确判定二尖瓣狭窄的程度
A. 心电图检查
B. 胸部摄片
C. 胸CT扫描
D. 超声心动检查
E. 听诊

正确答案：D。超声心动检查

解析：二尖瓣狭窄最常见的病因是风湿热，对二尖瓣狭窄程度的判定最有价值的检查是超声心动图检查（D对）。超声心动图检查有助于观察瓣叶的活动度、瓣叶的厚度以及瓣叶是否有钙化。心电图检查（A错）、胸部摄片（B错）、胸CT扫描（C错）、听诊（E错）对二尖瓣狭窄的判定有一定意义，但不是最有价值的检查。